在碱液中易发生消除反应的是
A. 毛茛苷
B. 藏红花苦苷
C. 芦荟苷
D. 腺苷
E. 鸟苷

正确答案：B。藏红花苦苷

解析：本题考查的是苷键的碱催化水解。在碱液中易发生消除反应的是藏红花苦苷（B对）。苷键的碱催化水解：一般的苷键对稀碱应该相当稳定，不易被碱催化水解，但苷键具有酯的性质时，如苷元为酸、酚、有羰基共轭的烯醇类或成苷的羟基β-位有吸电子基取代者，遇碱就能水解。如水杨苷、4-羟基香豆素苷、藏红花苦苷等都可为碱所水解。对于苷键β-位有吸电子基团者，在碱液中易发生消除反应，而得到脱水苷元，例如藏红花苦苷通过碱水解生成双烯醛。